主要用于解热镇痛，但几乎没有抗炎作用的药物是
A. 阿司匹林
B. 塞来昔布
C. 吲哚美辛
D. 对乙酰氨基酚
E. 布洛芬

正确答案：D。对乙酰氨基酚

解析：本题考查对乙酰氨基酚。对乙酰氨基酚（D对）用于普通感冒或流行性感冒引起的发热，也可用于缓解轻至中度疼痛，，其主要用于解热镇痛，几乎没有抗炎作用；阿司匹林（A错）具有缓解疼痛，抑制血栓形成及抗炎作用；塞来昔布（B错）为选择性COX-2抑制剂，且具有抗炎作用；吲哚美辛（C错）用于各类关节炎、软组织损伤、各种疼痛等，且具有抗炎作用；布洛芬（E错）用于缓解轻至中度疼痛，也用于普通感冒或流行性感冒引起的发热，且具有抗炎作用。